患者戴用全口义齿一周后，自诉义齿松动，易脱落。在询问病史时，要着重了解的是
A. 怎样松动
B. 松动程度如何
C. 何时义齿松动
D. 过去是否戴过义齿
E. 是否能吃饭

正确答案：C。何时义齿松动

解析：本题考查医生与患者的交流。根据义齿松动时间或条件不同，反应义齿存在不同的问题，并采取相应的解决方式。例如，当口腔处于休息状态时，义齿容易松动脱落，是由于基托组织面与黏膜不密合或基托边缘伸展不够；当口腔处于休息状态时，义齿固位良好，但张口说话时一次会容易脱落，是由于基托边缘过长过厚，影响系带活动等；固位尚好，但在咀嚼食物时义齿容易脱位，是由于（牙合）不平衡（C对）。义齿无论怎样松动（A错）或松动程度如何（B错），都说明义齿固位不良，应采取相应的解决办法，加强义齿的固位。过去是否戴过义齿是询问病史的内容之一，但患者主诉义齿松动脱落，与过去是否戴过义齿（D错）无关。是否能吃饭（E错）反应（牙合）关系是否平衡，与义齿松动容易脱落无关。